G.V.Black窝洞分类法的依据是
A. 牙体的解剖形态
B. 龋损所在牙面的部位
C. 窝洞所在的部位
D. 龋洞的大小
E. 充填材料的性质

正确答案：B。龋损所在牙面的部位

解析：G.V.Black分类：根据龋损所在牙面的部位，从治疗的观点出发，1908年Black把窝洞分为5类，目前仍作为充填治疗的基础分类，被广泛应用。掌握“银汞充填窝洞的概念”知识点。